布雷迪曾做过这样的实验，两只猴子各坐在自己被约束的椅子上，每隔一定时间通一次电，其中一只猴子（A）能自己断电而避免电击，另一只猴子（B）则不能，最终
A. A得了溃疡病
B. B得了溃疡病
C. A、B均得了溃疡病
D. A、B均未得病
E. A、B均得了高血压

正确答案：B。B得了溃疡病